因果关系的多样性、复杂性体现在多个方面，但不包括
A. 单因多果
B. 多因单果
C. 多因多果
D. 混杂因素的存在
E. 直接病因和间接病因的存在

正确答案：D。混杂因素的存在

解析：本题考查因果关系的多样性。因果关系的多样性包括：1.单因单果；2.单因多果（A对）；3.多因单果（B对）；4.多因多果（C对）；5.直接病因和间接病因的存在（E对）。因果关系的多样性、复杂性体现在多个方面，但不包括混杂因素的存在（D错，为本题正确答案）。